心肌不会发生强直收缩的原因是
A. 心肌是功能上的合胞体
B. 肌质网不发达，Ca²⁺贮存少
C. 有效不应期特别长
D. 会自动节律收缩
E. 心肌呈“全或无”式收缩

正确答案：C。有效不应期特别长